可用于治疗青光眼的药物是
A. 度冷丁
B. 新斯的明
C. 阿托品
D. 毛果芸香碱
E. 吗啡

正确答案：D。毛果芸香碱

解析：毛果芸香碱能直接作用于副交感神经（包括支配汗腺交感神经）节后纤维支配的效应器官的M胆碱受体，尤其对眼和腺体作用明显。临床应用于：青光眼、虹膜睫状体炎（D对）。